某女，51岁。因反复胸闷、胸痛2年余就诊，2年前因琐事与人争吵后，出现左前胸胀痛，伴胸胁胀痛，心悸，休息后缓解，未予重视。此后，胸闷胸痛反复发作，多于情绪波动后症状加重，严重时可放射至左后肩。患者情志抑郁，善太息，纳差，寐欠安，小便黄，大便失调，唇舌紫暗，脉弦涩。既往有慢性乙型肝炎10余年，对酒精过敏。临床给予血脂、肝肾功能、心肌酶谱、心电图及平板运动试验等检查。西医诊断为冠心病心绞痛；中医诊断为胸痹，辨证为气滞血瘀证。处方如下：中药汤剂：柴胡10g，赤芍10g，炒枳壳10g，生甘草10g，桃仁10g，红花9g，生地黄15g，川牛膝10g，当归9g，党参15g，炙乳没（各）6g，桔梗9g，川楝子15g，延胡索粉（分冲）3g。共5剂，水煎服，每日1剂，早、晚分服。中成药：血府逐瘀口服液10ml×12支，每次10ml，3次/日；复方丹参滴丸25mg×100丸，10丸/次，3次/日；速效救心丸40mg×100丸，舌下含服10粒，必要时服用；茵栀黄口服液10ml×10支，每次10ml，3次/日。执业药师在审核该患者的中药饮片处方时，应指出处方存在的问题是
A. 党参与赤芍属配伍禁忌
B. 生地黄的每日剂量超量
C. 川楝子的每日剂量超量
D. 延胡索粉的脚注错误
E. 炙乳没应是炙乳香

正确答案：C。川楝子的每日剂量超量

解析：本题考查的是有毒、小毒中药的用法用量及调剂。执业药师在审核该患者的中药饮片处方时，应指出处方存在的问题是川楝子的每日剂量超量（C对）。川楝子：有小毒的用法用量：5～10g。外用适量，研末调涂。该患者的中药处方中川楝子15g，每日剂量超量。党参与赤芍不属配伍禁忌（A错）。生地黄用法用量：内服：煎汤，10～30g。处方中生地黄15g，每日剂量正常（B错）。为避免延胡索粉与其他药同煎而导致其成分被药渣吸附而影响药效，故应冲服，脚注无误（D错）。炙乳没应是炙乳香、炙没药（E错）。